将患根分叉病变的多根牙中破坏最严重的牙根截除，同时保留牙冠和其余的牙根，继续行使功能，此种方法是
A. 翻瓣术
B. 植骨术
C. 引导性组织再生术
D. 截根术
E. 牙半切术

正确答案：D。截根术

解析：截根术：将患根分叉病变的多根牙中破坏最严重的一个或两个牙根截除消灭分叉区病变，同时保留牙冠和其余的牙根，继续行使功能。掌握“根分叉病变”知识点。